食物中亚硝基化合物含量最高的是
A. 蔬菜水果
B. 酸菜
C. 罐头食品
D. 鱼类食品
E. 蛋奶类食品

正确答案：D。鱼类食品